下列疾病，一般不会引起出血时间延长的是
A. 维生素C缺乏症
B. 血小板无力症
C. 血管性血友病
D. 缺铁性贫血
E. 巨大血小板综合征

正确答案：D。缺铁性贫血

解析：一般不会引起出血时间延长的是缺铁性贫血（D错，为本题正确答案），缺铁性贫血属于贫血性血液系统疾病，常表现为红细胞和血红蛋白减少，但一般不会引起出血时间延长。维生素C缺乏症（A对）常出现毛细血管壁异常；血小板无力症（B对）常出现血小板功能异常；血管性血友病（C对）常出现某些凝血因子严重缺乏，巨大血小板综合征（E对）常出现血小板减少。以上四者均可出现出血时间延长。